关于上颌尖牙邻面解剖特点说法错误的是
A. 邻面似三角形，较切牙邻面突出
B. 近中面比远中面更突且短小
C. 近中接触区距离近中切角更近
D. 远中接触区距远中切角稍远
E. 近远中接触区的位置与上颌中切牙类似

正确答案：B。近中面比远中面更突且短小

解析：上颌尖牙邻面解剖特点：似三角形，较切牙邻面突出。远中面比近中面更突且短小。近中接触区距近中切角较近，远中接触则距远中切角稍远。掌握“上下颌前牙的外形及临床应用解剖”知识点。